复层扁平上皮分布于
A. 胃
B. 小肠
C. 肛管
D. 结肠
E. 空肠

正确答案：C。肛管

解析：复层扁平上皮分布于肛管内(C对)。